既往月经规律，妊娠42⁺⁵周，下列情况的确最不可能出现的是
A. 羊水增多
B. 羊水粪染
C. 胎儿生长受限
D. 胎儿过熟综合征
E. 胎盘功能正常

正确答案：A。羊水增多

解析：过期妊娠的主要病理变化包括胎盘、羊水和胎儿三方面。胎盘病理有两种类型：一种是胎盘功能正常（E对），除重量略有增加外，胎盘外观和镜检均与足月妊娠胎盘相似；另一种是胎盘功能减退。正常38周后，羊水随妊娠推延逐渐减少（A错，为本题正确答案），妊娠42周后羊水迅速减少，约30%减至300ml以下；羊水粪染率明显增高（B对），是足月妊娠的2-3倍。过期妊娠胎儿生长模式与胎盘功能有关，可分为3种：正常生长及巨大胎儿、胎儿过熟综合征（D对）、胎儿生长受限（C对）。